药物排泄的主要器官是
A. 肝脏
B. 肾脏
C. 肺
D. 胆
E. 心脏

正确答案：B。肾脏

解析：本题考查药物的排泄。肾脏（B对）是药物排泄的主要器官，肝脏（A错）为药物代谢器官，肺（C错）胆（D错）参与药物吸收代谢过程，心脏（E错）是泵血器官。